将不良反应降低到最低限度的关键是
A. 确保用药有效
B. 做好售后服务
C. 选择优质产品
D. 监督临床用药
E. 合理用药

正确答案：E。合理用药

解析：本题考查的是合理用药的目的和意义。将不良反应降低到最低限度的关键是合理用药（E对）。合理用药的目的，首先就是要最大限度地发挥药物治疗效能，将中药和中成药的不良反应降低到最低限度，甚至于零。其次是使患者用最少的支出，冒最小的风险，得到最好的治疗效果。其三是最有效地利用卫生资源，减少浪费，减轻患者的经济负担。其四是方便患者使用所选药物。合理用药是在充分考虑患者用药后获得的效益与承担的风险后作出的最佳选择。即使药效得到充分发挥，不良反应降至最低水平，药品费用更为合理。合理用药与广大群众的切身利益息息相关，是用药安全、有效、简便、经济的保障。合理用药可以经济有效地利用卫生资源，取得最大的医疗和社会效益，避免浪费。